女，21岁。1型糖尿病8年，平素每日4次（R-R-R-N）胰岛素皮下注射治疗，定期查糖化血红蛋白7.5%～8%，2日前患者受凉后发热，体温37.5℃～38℃，因食欲不佳，自行停用胰岛素，改用阿卡波糖治疗。渐出现恶心。食欲不振，呕吐少量胃内容物，尿中有异味。查体：102次/分。BP90/60mmHg，体重55Kg，轻度脱水貌，精神萎靡，实验室检查：随机血糖25.6mmol/L，血钾4.8mmol/L，血纳144mmol/L，尿糖（++++），尿酮体（+++）；动脉血气分析pH值7.25。患者入院后尿量约50ml/h，复查血钾4.0mmol/L。关于补钾治疗应采取
A. 每2小时测定血钾，低于3.5mmol/L开始补钾
B. 开始口服补钾
C. 开始静脉补钾
D. 两次检测血钾均正常，不需要补钾
E. 观察尿量如果有进一步的增加，则补钾

正确答案：C。开始静脉补钾

解析：DKA 病人有不同程度失钾 ，治疗前的血钾水平不能真实反映体内缺钾程度，补钾应根据血钾和尿量：治疗前血钾低于正常，在开始胰岛素和补液治疗同时立即开始补钾；血钾正常尿量>40ml/h， 也立即开始补钾；血钾正常尿量 <30ml/h， 暂缓补钾，待尿量增加后再开始补钾；血钾高于正常暂缓补钾 。患者入院后尿量约50ml/h，复查血钾4.0mmol/L，根据尿量和血钾浓度，补钾治疗应采取静脉补钾（C对）。